患者面白无华，唇色淡白，爪甲苍白，头晕眼花，心悸失眠，手足麻木，舌淡脉细，辨证当属
A. 气虚证
B. 阳虚证
C. 血虚证
D. 阴虚证
E. 心脾两虚证

正确答案：C。血虚证

解析：血液亏虚，不能濡养头目，上荣舌面，故面白无华，唇色淡白，头晕眼花；血虚心失所养则心悸，神失滋养则失眠；血少不能濡养筋脉、肌肤，故手足麻木，爪甲苍白；故辨证为血虚证（C对）。气虚证的证候表现为神疲乏力，少气懒言，气短，头晕目眩，自汗，动则诸症加剧，舌质淡嫩，脉虚（A错）。阳虚证的证候表现为畏寒，肢冷，口淡不渴，或喜热饮，或自汗，小便清长或尿少浮肿，大便稀薄，面色㿠白，舌淡胖嫩，苔白滑，脉沉迟无力。可兼有神疲、乏力、气短等气虚表现（B错）。阴证的证候表现为形体消瘦，口燥咽干，两颧潮红，五心烦热，潮热盗汗，小便短黄，大便干结，舌红少津、少苔，脉细数等（D错）。心脾两虚证的证候表现为心悸怔忡，失眠多梦，食欲不振，腹胀便溏，面色萎黄，眩晕耳鸣，神疲乏力，或见各种慢性出血，血色淡，舌淡嫩，脉弱（E错）。